子宫内膜增生症对机体最大的危害是
A. 癌变
B. 导致性激素水平的紊乱
C. 导致功能性子宫出血
D. 导致不孕症
E. 导致流产

正确答案：A。癌变

解析：子宫内膜增生症分为：①单纯性增生，发展为子宫内膜腺癌的几率仅约1%；②复杂型增生，约3%可发展为子宫内膜腺癌；③不典型增生发展为子宫内膜腺癌的几率为23%。子宫内膜增生症虽可导致性激素水平的紊乱（B错）、功能性子宫出血（C错）、不孕症（D错）及流产（E错），但癌变（A对）对机体危害最大。